三酰甘油高于正常值，其临床意义是
A. 肝功能严重障碍
B. 甲状腺功能亢进
C. 肾上腺皮质功能减退
D. 甲状旁腺功能亢进
E. 动脉粥样硬化

正确答案：E。动脉粥样硬化

解析：本题考查的是三酰甘油的临床意义。三酰甘油高于正常值，其临床意义是动脉粥样硬化（E对）。三酰甘油又称甘油三酰（TG），是甘油和3个脂肪酸所形成的脂类物质，主要在肝脏合成，小肠黏膜在类脂吸收后也合成大量的TG，进食脂肪餐后会导致饮食性脂血。TG主要存在于极低密度脂蛋白（VLDL）和乳糜微粒（CM），可直接参与胆固醇和胆固醇酯的合成。TG是动脉粥样硬化（AS）的独立危险因素和导致脂肪肝的主要原因。TG升高和降低均有临床意义。三酰甘油的临床意义：1.升高：（1）血脂异常：高甘油三酯血症或混合型高脂血症。（2）其他疾病：糖尿病、痛风、肾病综合征及阻塞性黄疸等。（3）其他：高脂饮食、运动不足等。2.降低：（1）原发性β-脂蛋白缺乏症。（2）其他疾病：甲状腺功能亢进症（D错）、严重肝病（A错）、肾上腺皮质功能减退（C错）、恶性肿瘤晚期、吸收不良等。甲状旁腺功能亢进（B错）造成改变的检查项目，2022年考试指南未明确说明。